对于青霉素G，描述不正确的是
A. 能口服
B. 易产生过敏
C. 对革兰氏阳性菌效果好
D. 易产生耐药性
E. 是第一个用于临床的抗生素

正确答案：A。能口服